患者，男，48岁。身热头痛，干咳无痰，气逆而喘，鼻燥咽干，心烦口渴，胸满胁痛，舌干无苔，脉虚大而数。治疗应首选
A. 杏苏散
B. 桑杏汤
C. 百合固金汤
D. 清燥救肺汤
E. 麦门冬汤

正确答案：D。清燥救肺汤

解析：清燥救肺汤为治燥剂，具有清燥润肺，养阴益气之功效。主治温燥伤肺，气阴两伤证。身热头痛，干咳无痰，气逆而喘，咽喉干燥，鼻燥，心烦口渴，胸满胁痛，舌干少苔，脉虚大而数（A对）。麦门冬汤具有清养肺胃，降逆下气之功效。主治虚热肺痿。咳嗽气喘，咽喉不利，咯痰不爽，或咳唾涎沫，口干咽燥，手足心热，舌红少苔，脉虚数（B错）。杏苏散具有轻宣凉燥，理肺化痰之功效。主治外感凉燥证。恶寒无汗，头微痛，咳嗽痰稀，鼻塞咽干，苔白脉弦（C错）。桑杏汤具有清宣温燥，润肺止咳之功效。主治外感温燥证。身热不甚，口渴，咽干鼻燥，干咳无痰或痰少而粘，舌红，苔薄白而干，脉浮数而右脉大者（D错）。百合固金汤具有滋养肺肾，止咳化痰之功效。主治肺肾阴亏，虚火上炎证。咳嗽气喘，痰中带血，咽喉燥痛，头晕目眩，午后潮热，舌红少苔，脉细数（E错）。